关于tRNA的描述哪一项是正确的
A. 5′端是-CCA
B. tRNA是由103核苷酸组成
C. tRNA的5′-末端总是pG
D. tRNA由73～93个核苷酸组成
E. 在其DHU环中有反密码子

正确答案：D。tRNA由73～93个核苷酸组成

解析：tRNA是单链小分子，由73～93个核苷酸组成；在tRNA的二级结构DHU环和TψC环（又称茎环）结构，其上携带反密码子；不同的tRNA有不同的反密码子，故tRNA上的5’-末端携带的密码子是不同的。掌握“RNA”知识点。